牙釉质表面的主要无机物是
A. 铁和锌
B. 钙和磷
C. 镁和钠
D. 氟和氯
E. 碳酸盐

正确答案：B。钙和磷

解析：釉质的无机物主要由含钙（Ca2+）、磷（P3-）离子的磷灰石晶体和少量的其他磷酸盐晶体等组成。掌握“牙釉质”知识点。